关于管型的叙述，正确的是
A. 红细胞管型，常见于急性肾炎
B. 白细胞管型，常见于急性肾衰竭
C. 脂肪管型，常见于肾盂肾炎
D. 蜡样管型，常见于肾病综合征
E. 上皮细胞管型，常见于慢性肾炎晚期

正确答案：A。红细胞管型，常见于急性肾炎

解析：红细胞管型常见于急性肾炎（A对）。白细胞管型常见于活动性肾盂肾炎、间质性肾炎（B错）。脂肪管型常见于肾病综合征（C错）。蜡样管型常见于慢性肾小球肾炎（D错）。上皮细胞管型常见于肾病综合征（E错）。